牙挺使用时应遵循的规则，除外
A. 不能以邻牙作支点
B. 颊侧需去骨者外，龈缘水平处的颊侧骨板一般不应作为支点
C. 龈缘水平处的舌侧骨板可作为支点
D. 以手指保护，以防牙挺滑脱
E. 用力必须有控制，挺刃的用力方向必须正确

正确答案：C。龈缘水平处的舌侧骨板可作为支点

解析：牙挺使用时，必须遵循下列规则：①绝不能以邻牙作支点；②除拔除阻生牙或颊侧需去骨者外，龈缘水平处的颊侧骨板一般不应作为支点；③龈缘水平处的舌侧骨板，也不应作为支点；④必须以手指保护，以防牙挺滑脱；⑤用力必须有控制，挺刃的用力方向必须正确。掌握“牙拔除术前准备、器械、心血管及拔牙愈合过程”知识点。